治疗血吸虫病的药物是
A. 喹诺酮类药物
B. 吡喹酮
C. 氯喹
D. 奎宁
E. 伯氨喹

正确答案：B。吡喹酮

解析：血吸虫首选吡喹酮（B对）。吡喹酮的毒性小、疗效好、给药方便、适应症广，可用于各期各型血吸虫病患者，是目前用于治疗血吸虫病最有效的药物。吡喹酮对血吸虫各个发育阶段均有不同程度的杀灭效果。有显著杀灭血吸虫成虫的作用。吡喹酮破坏虫体内的钙离子平衡，使虫体兴奋、挛缩，虫体皮层受损，呈空泡变性，影响虫体蛋白和糖代谢等。同时暴露虫体表抗原决定簇，使宿主的免疫系统得以识别并攻击。对发育成熟的虫卵有效，含毛蚴的虫卵治疗后呈空泡样变性。对水中尾蚴杀伤作用强。吡喹酮口服后迅速吸收，1~2小时达血药峰值。经肝代谢，主要分解成羟基代谢产物，门静脉血浓度较外周血高数倍至数十倍以上，主要分布在肝，其次为肾肺、脑垂体等。半衰期为1-1.5小时。80%药物于4天内以代谢产物形式由肾排出，其中90%在24小时内排出。